瑞格列奈可用于治疗
A. 高血压
B. 高血脂症
C. 1型糖尿病
D. 2型糖尿病
E. 甲状腺功能亢进

正确答案：D。2型糖尿病

解析：本题考查瑞格列奈的临床作用。瑞格列奈为非磺酰脲类促胰岛素分泌药，能够促进胰岛素的早期分泌，主要用于治疗2型糖尿病（D对）。高血压（A错）选用降压药如氨氯地平等进行治疗。高血脂（B错）可用降血脂药进行治疗。1型糖尿病（C错），又称胰岛素依赖型糖尿病，体内胰岛素绝对不足，必须用胰岛素治疗。甲状腺功能亢进症（E错）用抗甲状腺素药进行治疗。